治疗丹痧邪侵肺卫证，应首选
A. 宣毒发表汤
B. 清解透表汤
C. 透疹凉解汤
D. 解肌透痧汤
E. 凉营清气汤

正确答案：D。解肌透痧汤

解析：丹痧邪侵肺卫证，治疗应辛凉宣透，清热利咽，方用解肌透痧汤加减（D对）。宣毒发表汤功能辛凉透表、清宣肺卫，用于麻疹之邪犯肺卫证（A错）。清解透表汤功能清凉解毒，透疹达邪，用于麻疹见形期（B错）。透疹凉解汤功能清气凉营解毒，用于风痧之邪入气营证（C错）。凉营清气汤功能清气凉营，泻火解毒，用于猩红热之毒炽气营证（E错）。